在脂质体的质量要求中，表示脂质体化学稳定性的项目是
A. 载药量
B. 渗漏率
C. 磷脂氧化指数
D. 释放度
E. 包封率

正确答案：C。磷脂氧化指数

解析：本题考查脂质体。在脂质体的质量要求中，表示脂质体化学稳定性的项目是磷脂氧化指数（C对）。载药量（A错）指脂质体中所包封药物重量的百分率。可以明确制剂中药物的百分含量，对脂质体的工业化生产具有实用价值。脂质体中药物的泄漏率（B错）表示脂质体在贮存期间包封率的变化情况，是衡量脂质体物理稳定性的主要指标。脂质体的质量要求中没有对释放度（D错）的要求。包封率（E错）是指包入脂质体内的药物量与投料量的重量百分比。通常要求脂质体的药物包封率达80%以上。